心脏病孕妇产后出血时禁用
A. 硫酸镁
B. 催产素
C. 麦角新碱
D. 前列腺素
E. 青霉素

正确答案：C。麦角新碱

解析：麦角新碱可使静脉压升高，所以禁用于有心脏病的孕妇。掌握“娠期高血压疾病”知识点。